男，4岁。诊断为血友病甲，有牙龈出血。输血用
A. 冷沉淀
B. 全血
C. 浓缩红细胞
D. 血小板
E. 白细胞

正确答案：A。冷沉淀

解析：男性患儿4岁，诊断为血友病甲（凝血因子Ⅷ异常的遗传性出血疾病），有牙龈出血，输血时应用冷沉淀（A对）。冷沉淀是FFP（新鲜冰冻血浆）在4℃融解时不融的沉淀物，主要包含纤维蛋白原和FⅧ，主要用于血友病甲、先天或获得性纤维蛋白缺乏症。全血（B错）主要用于治疗失血量在30%以上者，补充因失血而丧失的血细胞及血浆蛋白。浓缩红细胞（C错）主要用于治疗各种急性失血，慢性贫血及心功能不全者输血。血小板（D错）主要用于治疗对白细胞凝集素有发热反应者及肾功能不全不能耐受库存血中高钾者。白细胞（E错）主要通过白细胞制剂进行输注，现因输注后并发症多，现已较少应用。